成人患牙三氧化二砷封药时间为
A. 30～40分钟
B. 24～48小时
C. 3天
D. 半个月
E. 1个月

正确答案：B。24～48小时

解析：成人患牙三氧化二砷封药时间为24～48小时（B对）。三氧化二砷为牙髓失活剂，对细胞原生质有强烈的毒性作用，作为失活剂一般封药24～48小时，其对组织的毒性作用没有自限性，可以破坏深部组织，因此失活牙髓时，必须控制药物作用的时间，使其作用于牙髓。封药的时间少于24小时（A错），则失活效果不足；超过48小时（CDE错），三氧化二砷的毒性作用将不仅限于髓腔内，则可能会破坏深部组织。